唾液样本中最常分离到的乳杆菌是
A. 嗜酸乳杆菌
B. 血链球菌
C. 变形链球菌
D. 发酵乳杆菌
E. 干酪乳杆菌

正确答案：A。嗜酸乳杆菌

解析：乳杆菌属包括两种，一类是同源发酵菌种，代表为嗜酸乳杆菌；另一类为异源发酵菌种，代表为发酵乳杆菌。而在唾液样本中最常分离到的菌种是嗜酸乳杆菌，在牙菌斑样本中最常见者为发酵乳杆菌。掌握“龋病概述”知识点。